促进扩散的特点是
A. 药物由高浓度区域向低浓度区域扩散
B. 需要能量
C. 借助于载体使非脂溶性药物由高浓度区域向低浓度区域扩散
D. 小于膜孔的药物分子通过膜孔进入细胞膜
E. 黏附于细胞膜上的某些药物随着细胞膜向内凹陷进入细胞内

正确答案：C。借助于载体使非脂溶性药物由高浓度区域向低浓度区域扩散

解析：本题考查药物的转运方式。促进扩散是指物质借助载体由高浓度区域向低浓度区域扩散的过程（C对A错）；促进扩散为被动运输方式，无需能量（B错）；小于膜孔的药物分子通过膜孔进入细胞膜（D错）的方式为膜孔转运；黏附于细胞膜上的某些药物随着细胞膜向内凹陷（E错）进入细胞内称为胞饮。